股骨中下1/3骨折最经典的骨折类型是
A. 骨折远端向内移位
B. 骨折远端向后移位
C. 骨折断端向前方成角
D. 骨折远端向前移位
E. 骨折近端向侧方移位

正确答案：B。骨折远端向后移位

解析：股骨下1/3骨折后，远折段则受腓肠肌的牵拉而向后倾倒，因此，骨折远端向后移位（B对）。